男，70岁。上腹痛1年，进食后加重，大便10次/天，可见脂肪滴。查体：上腹中部压痛（+）。腹部B超：胰腺多发钙化灶。应给予的药物是
A. 胰酶制剂
B. 质子泵抑制剂
C. 钙通道阻滞剂
D. H₂受体拮抗剂
E. 抗胆碱药物

正确答案：A。胰酶制剂

解析：老年男性患者，上腹痛1年、进食后加重，大便10次/天，可见脂肪滴（腹痛、脂肪泻为慢性胰腺炎的常见症状）。查体：中腹部压痛（+）（慢性胰腺炎的常见体征）。腹部B超示胰腺多发钙化灶（慢性胰腺炎的典型影像学表现）。综合患者的病史、查体、影像学检查，可初步诊断为慢性胰腺炎。患者主要症状为脂肪泻，主要是由胰腺外分泌功能不全导致的胰酶减少，脂肪未被分解利用而直接排出体外引起。口服胰酶制剂（A对）可以帮助脂肪类食物的消化，改善病情。胰酶制剂应餐中服用，同时应用质子泵抑制剂（B错）或H2受体拮抗剂（D错）抑制胃酸分泌，可减少胃酸对胰酶的破坏，提高胰酶制剂的疗效。钙通道阻滞剂（C错）主要用于心律失常、高血压、心绞痛等疾病的治疗。抗胆碱药物（E错）主要用于抢救感染中毒性休克、解除有机磷农药中毒、阿斯综合征和内脏绞痛等。